可引起先天性婴儿畸型的常见病毒是
A. 风疹病毒
B. 麻疹病毒
C. 狂犬病毒
D. 脊髓灰质炎病毒
E. EB病毒

正确答案：A。风疹病毒

解析：可引起先天性胎儿畸形的常见病毒包括风疹病毒（A对）、巨细胞病毒等，妊娠3个月以内，胎盘屏障尚未发育完善，在此期间，孕妇若感染风疹病毒或巨细胞病毒（CMV），极易通过胎盘感染胎儿，引起先天性畸形或流产（八版妇产科学P34）。麻疹病毒（B错）属于副黏菌病毒科，传染性强，常见于儿童，以皮丘疹、发热及呼吸道症状为特征，主要通过飞沫传播，无并发症，预后良好（P243）。狂犬病毒（C错）属于弹状病毒科，对神经组织有很强的亲和性，可侵入脊髓和中枢神经系统，形成如痉挛、麻痹和昏迷等神经症状为主的临床表现，通过动物咬伤或密切接触等形式在动物间或动物人类间传播（P313）。脊髓灰质炎病毒（D错）是肠道病毒，主要侵犯脊髓前角运动神经细胞，导致急性迟缓性肢体麻痹，即小儿麻痹症，主要通过粪-口途径传播（P251）。B病毒（E错）又叫猴疱疹病毒，同人单纯性疱疹病毒相近，可使人类产生致死性脑炎，不引起胎儿畸形（八版医学微生物学未详细说明）。